左旋多巴的作用是
A. 促进DA神经元释放DA，抑制DA摄取
B. 在脑内转变为DA，补充纹状体中DA之不足
C. 激动DA受体
D. 阻断中枢胆碱受体
E. 兴奋中枢胆碱受体

正确答案：B。在脑内转变为DA，补充纹状体中DA之不足

解析：进人脑组织左旋多巴，经脑内AADC脱羧转化为DA，补充纹状体DA不足，产生抗帕金森病作用（B对）。